下列各项，不属于瘀血致病症状特点的是
A. 痛处固定
B. 爪甲紫暗
C. 肌肤甲错
D. 夜间痛甚
E. 疼痛胀满

正确答案：E。疼痛胀满

解析：瘀血生成之后，停积于体内，影响血脉运行；旅血阻滞经脉，气血运行不利，形体官窍因脉络淤阻可见爪甲紫暗（B对）；淤血日久不散，就会严重地影响气血的运行，脏腑失于濡养，功能失常，生机受阻，势必影响新血的生成，故久淤之人，常可表现出肌肤甲错（C对）、毛发不荣等失于濡养的临床特征。痪血一旦停滞于某脏腑组织，多难于及时消散，故其致病又具有病位相对固定的特征（A对）；有形瘀血停积于局部，气血不畅，由于夜间血行缓慢，瘀阻更重，故夜间痛甚（D对）；疼痛胀满多由于气滞引起（E错，为本题正确答案）。